围成胸廓下口的结构，不包括
A. 第12胸椎
B. 第11、12肋前端
C. 肋弓
D. 剑突
E. 胸骨角

正确答案：E。胸骨角

解析：胸廓下口由第 12 胸椎（A对）、第 11及 12 对肋前端（B对）、肋弓和（C对）剑突（D对）围成。胸骨角（E错，为本题正确答案）是胸骨柄与胸骨体连接的地方，是计数肋的标志，不参与围城胸廓下口。